大气质量玫瑰图中圆的直径表示
A. 大气污染超标指数I₂
B. 大气质量指数I₁
C. 总悬浮颗粒的超标分指数
D. 铅的日平均浓度
E. SO₂的一次浓度

正确答案：B。大气质量指数I₁

解析：本题考查大气质量玫瑰图中圆的直径表示含义。大气质量玫瑰图中圆的直径表示大气质量指数I₁（B对ACDE错）。大气质量指数I₁是兼顾最高分指数和平均分指数的环境质量指数。